化妆品中过量的重金属主要源于
A. 为防腐而添加
B. 生产过程和原材料
C. 使用过程的污染
D. 包装容器
E. 为着色而添加

正确答案：B。生产过程和原材料

解析：本题考查化妆品中重金属的主要来源。化妆品中的重金属大多源于污染，常见的污染重金属有铅、汞、砷等，主要来源于生产过程和原材料（B对ACDE错）。